关于复发性脱位的说法不正确的是
A. 又称习惯性脱位
B. 急性前脱位后未予以适当治疗，造成关节韧带、关节囊松弛
C. 长期翼外肌功能亢进，使关节囊、韧带松弛
D. 长期慢性消耗性疾病常发生复发性脱位
E. 肌张力失常时复发性脱位少见

正确答案：E。肌张力失常时复发性脱位少见

解析：复发性脱位颞下颌关节前脱位反复发作，造成患者言语、进食困难，又称习惯性脱位。急性前脱位后未予以适当治疗，使得被撕裂的韧带、关节囊等未得到修复，造成关节韧带、关节囊松弛；其次由于长期翼外肌功能亢进，髁突运动过度，使关节囊、韧带松弛，也可造成复发性脱位；老年人、长期慢性消耗性疾病、肌张力失常等也常发生复发性脱位。掌握“颞下颌关节脱位”知识点。